病理性缩复环关系密切的是
A. 臀先露
B. 面先露
C. 胎头高直位
D. 嵌顿性肩先露
E. 枕后位

正确答案：D。嵌顿性肩先露

解析：肩先露时，临产后宫缩不断加强，胎肩及胸廓一部分被挤入盆腔内，胎体折叠弯曲，胎颈被拉长，上肢脱出于阴道口外，胎头和胎臀被阻于骨盆入口上方，形成忽略性（嵌顿性）肩先露。后随子宫收缩继续增强子宫上段越来越厚，子宫下段被动扩张越来越薄，由于子宫上下段肌壁厚薄相差悬殊，形成环状凹陷，并随宫缩逐渐升高，甚至可以高达脐上，形成病理缩复环，为子宫破裂的先兆，若不及时处理，将发生子宫破裂。故病理性缩复环关系密切的是嵌顿性肩先露（D对）。